患者男。48岁。近八个月来感觉烦躁不安饥饿伴精神症状。近两个月来经常有晨起昏迷。服用糖水后清醒。发作时血糖1.8～2.2mmol/L。否认既往有高血压糖尿病史。急诊入院查体，呼吸18次/分。血压120/80mmHg，脉搏94次/分。双肺听诊无干湿啰音。无异常心音。腹部平软无压痛反跳痛。该患者若收入院后有昏迷现象，需要进行的治疗措施是
A. 静脉注入，50%的葡萄糖溶液
B. 静脉注入20%的葡萄糖溶液
C. 口服葡萄糖溶液
D. 静脉注入10%的葡糖溶液
E. 胃管饲入高碳水化合物食物

正确答案：A。静脉注入，50%的葡萄糖溶液

解析：患者有典型Whipple三联征表现，即低血糖症状（大脑神经元低血糖症状：精神症状、甚至昏迷）、发作时血糖<2.8mmol/L（1.8-2.2mmol/L）、给予糖水后症状缓解。且患者晨起时昏迷，考虑胰岛素瘤低血糖所致昏迷，应给予50%葡萄糖液静脉注射（A对）。继以5%-10%葡萄糖液静脉滴注（BD错）。昏迷神志不清者，忌喂食以避免呼吸道窒息（CE错）。